骨与关节结核的手术适应症为
A. 年龄过大或过小
B. 有其他脏器活动性结核病变
C. 抗结核治疗在2周之内
D. 全身中毒症状严重，抗结核药物效果不佳
E. 窦道流脓经久不愈

正确答案：E。窦道流脓经久不愈

解析：骨与关节结核的手术治疗主要用于非手术治疗效果不佳、有明显死骨形成、窦道流脓经久不愈（E对）及有脊髓或马尾神经受压的患者。有其他脏器活动性结核病变（B错）、全身中毒症状严重及抗结核药物效果不佳者（D错）均禁忌手术治疗。抗结核治疗在2周之内（C错）的患者感染症状尚不足以控制，此时手术易造成结核杆菌的血源性播散。年龄过大或过小者（A错）对手术耐受性均较差，应以药物治疗为主，不是骨与关节结核的手术适应症。